突然停药后原有疾病加剧
A. 副作用
B. 毒性反应
C. 后遗效应
D. 停药反应
E. 变态反应

正确答案：D。停药反应

解析：停药反应是指病人长期用药，突然停药后原有疾病加剧，又称回跃反应。例如高血压病人长期服用可乐定降血压，若突然停药，次日血压将明显回升。掌握“药物不良反应”知识点。